下列直肠结构的说法，不正确的是
A. 位于第3骶椎至盆膈之间
B. 中间的直肠横襞位于直肠右壁，大而恒定，距肛门约7cm
C. 骶曲凸向后，会阴曲凸向前
D. 上段为腹膜内位，中、下段为腹膜外位器官
E. 血供主要来自肠系膜下动脉和髂内动脉的分支

正确答案：D。上段为腹膜内位，中、下段为腹膜外位器官

解析：直肠位于第3骶椎与盆膈之间(A对)，中直肠横襞常位于直肠右壁上，大且位置恒定，距肛门约7cm(B对)，骶曲凸向后，而会阴曲凸向前(C对)，直肠上段为腹膜间位器官(D错，为本题正确答案)，中、下段为腹膜外位器官，血供主要来自肠系膜下动脉的分支和髂内动脉的分支如直肠下动脉(E对)。